在突触传递过程中，引起递质释放的关键因素是
A. 兴奋传到神经末梢
B. 突触前膜发生去极化
C. Ca²⁺进入突触前末梢
D. 前膜内轴浆粘度的高低
E. 前膜内侧负电位的大小

正确答案：C。Ca²⁺进入突触前末梢

解析：在突触传递过程中，当突触前神经元的兴奋传到末梢时，突触前膜去极化，当去极化达一定水平时，突触前膜中的电压门控钙通道开放，细胞外的Ca²⁺进入突触前末梢（C对）轴浆内，导致轴浆内Ca²⁺浓度瞬时升高，升高的Ca²⁺可触发突触囊泡的出胞，促使轴突末梢释放神经递质。兴奋传到神经末梢（A错）、突触前膜发生去极化（B错）、前膜内轴浆粘度的高低（D错）及前膜内侧负电位的大小（E错）均非引起递质释放的关键因素。